某女，42岁。经血淋漓不断月余，气短懒言，倦怠乏力，面色苍白。舌淡，脉细弱无力。该病的病位在
A. 脾
B. 心
C. 肝
D. 肺
E. 肾

正确答案：A。脾

解析：本题考查的是脾气虚证的临床表现及辨证要点。经血淋漓不断月余，气短懒言，倦怠乏力，面色苍白。舌淡，脉细弱无力。该病的病位在脾（A对）。脾不统血证：临床表现常见面色苍白或萎黄，饮食减少，倦怠无力，气短，肌衄，便血以及妇女月经过多，或崩漏，舌质淡，脉细弱。一般以在脾气虚的基础上共见出血为辨证要点。1.心（B错）病主要证候有心气虚证、心阳虚证、心血虚证、心阴虚证、心血瘀阻证及心火亢盛证。2.肺（D错）病主要证候有肺气虚证、肺阴虚证、风寒犯肺证、风热犯肺证、燥热犯肺证及痰浊阻肺证。3.脾病的主要证候有脾气虚证、脾阳虚证、寒湿困脾证及脾胃湿热证。4.肝（C错）病主要证候有肝气郁结证、肝火上炎证、肝阳上亢证、肝风内动证、肝阴虚证、肝血虚证、肝胆湿热证及寒滞肝脉证。5.肾（E错）病的主要证候有肾阳虚证、肾阴虚证、肾精不足证、肾气不固证及肾不纳气证。